足阳明胃经的原穴是
A. 内庭
B. 陷谷
C. 冲阳
D. 解溪
E. 丰隆

正确答案：C。冲阳

解析：冲阳在足背最高处，当拇长伸肌腱和趾长伸肌腱之间，足背动脉搏动处，为足阳明胃经的原穴（C对）。内庭为足阳明胃经的荥穴（A错）。陷谷为足阳明胃经的输穴（B错）。解溪为足阳明胃经的经穴（D错）。丰隆为足阳明胃经的络穴（E错）。记忆：所有原穴，四老太太冲进大门求养三骨。太渊，太白，太冲，太白，太溪，冲阳，大陵，神门，丘墟，阳池，合谷，京骨，腕骨。